肢体屈伸不利可见受于
A. 风邪
B. 寒邪
C. 暑邪
D. 湿邪
E. 火邪

正确答案：B。寒邪

解析：凡致病具有寒冷、凝滞、收引等特点的外邪，称为寒邪。寒性收引，指寒邪侵袭人体，可使气机收敛，腠理、经络、筋脉收缩而挛急。寒客经络肢体关节，则经脉收缩拘急，屈伸不利（B对）。风为阳邪，轻扬开泄，易袭阳位；风性善行而数变；风性主动；风为百病之长（A错）。暑为阳邪，其性炎热；暑性升散，易扰心神，伤津耗气；暑多挟湿（C错）。湿为阴邪，易损伤阳气，阻遏气机；湿性重浊、黏腻；湿性趋下，易袭阴位（D错）。火热为阳邪，其性炎上；火热易扰神；火热易伤津耗气；火热易生风动血；火邪易致疮痈（E错）。